男，73岁。3年前出现右侧肢体活动不灵、右手静止性震颤，被诊断为帕金森病，复方左旋多巴治疗后病情稳定。近半年出现白天药效维持时间短缩，震颤明显。患者有肾功能不全、前列腺肥大病史。对该患者，最适当的处理是
A. 加用培高利特
B. 加用金刚烷胺
C. 增加复方左旋多巴剂量或次数
D. 加用苯甲托品
E. 加用苯海索

正确答案：C。增加复方左旋多巴剂量或次数

解析：患者诊断为帕金森病，用复方左旋多巴治疗3年后，出现白天药效维持时间短缩，震颤明显，为左旋多巴的“剂末效应”，最适当的处理是增加复方左旋多巴剂量或次数（ C对）。苯甲托品（8版药理P136）（D错）、苯海索（8版药理P135）（E错）为抗胆碱能药物，对不能接受左旋多巴或多巴胺受体激动药者，可用本药，但前列腺肥大者禁用，可能加重患者排尿困难。金刚烷胺（8版药理P135）（B错）可加强多巴胺功能，但作用持续时间短，连用6～8周后疗效逐渐减弱，且亦有抗胆碱作用，并且肾功能不全者慎用金刚烷胺。虽然加用DR激动剂也可缓解症状，但麦角类DR激动剂会导致心脏瓣膜病变和肺胸膜纤维化，现已不主张使用，其中培高利特（A错）国内已停用。